某项研究选择50名生育短肢畸形婴儿的母亲和90名生育正常婴儿的母亲，调查她们在怀孕初期是否服用过反应停，两组母亲分别有12人和2人回答服用过。利用上述资料回答下列问题。反应停与短肢畸形间的关联强度是
A. 13.9
B. 10.8
C. 2
D. 19
E. 7.3

正确答案：A。13.9

解析：本题考查比值比的计算。根据题中条件可计算出比值比＝ad/bc＝（12×88）/（2×38）＝13.9（A对BCDE错）。